足少阴肾经分布在
A. 下肢内侧后缘
B. 下肢外侧后缘
C. 下肢内侧前缘
D. 下肢外侧中线
E. 下肢外侧前缘

正确答案：A。下肢内侧后缘

解析：阴经行内侧，阳经行外侧，足少阴肾经分布在下肢内侧后缘（A对）；足太阳膀胱经分布在下肢外侧后缘（B错）；足太阴脾经分布在下肢内侧前缘（C错）；足少阳胆经分布在下肢外侧中线（D错）；足阳明胃经分布在下肢外侧前缘（E错）。